流行病学实验研究中下列哪条不是其缺点
A. 设计严格、实施困难、随访观察花费太大
B. 盲法不易实施、随访时间长、研究人群依从性差
C. 有随机分组很难控制偏倚
D. 易引起医德和伦理学的争议

正确答案：C。有随机分组很难控制偏倚

解析：本题考查实验流行病学的缺点。流行病学的缺点主要包括：①整个试验设计和实施条件要求高、控制严、难度较大，在实际工作中有时难以做到；②受干预措施适用范围的约束，所选择的研究对象代表性不够，以致会不同程度地影响试验结果推论到总体；③研究人群数量较大，试验计划实施要求严格，随访时间长，因此依从性不易做得很好，影响试验效应的评价。实验流行病学的随机分组（C错，为本题正确答案）有助于提高可比性，控制混杂偏倚，是实验流行病学的一大优点。